可以碱化尿液，用于代谢性酸中毒的药物是
A. 氯化铵
B. 氯化钠
C. 硫酸镁
D. 乳酸钠
E. 精氨酸

正确答案：D。乳酸钠

解析：本题考查乳酸钠。乳酸钠（D对）用于代谢性酸中毒，碱化体液或尿液。氯化铵（A错）用于酸化尿液。氯化钠（B错）用于调节渗透压。硫酸镁（C错）口服用来导泄。精氨酸（E错）与谷氨酸钠或谷氨酸钾联合应用，可增加治疗肝性脑病的疗效。